肠套叠的三大典型症状是
A. 腹痛，发热，黄疸
B. 腹痛，发热，脓血便
C. 腹痛，血便，里急后重
D. 腹痛，血便，腹部肿块
E. 腹痛，腹部肿块，发热

正确答案：D。腹痛，血便，腹部肿块

解析：肠套叠是指肠的一段套入其相连的肠管腔内，多见于婴幼儿，其三大典型症状腹痛、血便和腹部肿块（D对）。腹痛、发热和黄疸称为Charcot三联征，是胆管结石继发胆管炎的典型表现（A错）。腹痛、发热、黏血、里急后重等常见于细菌性痢疾、溃疡性结肠炎等疾病；腹部肿块可见于肠梗阻、胃肠道肿瘤等（BCE错）。